不符合化妆品的定义的产品是
A. 含抑制螨虫剂的洗头水
B. 香皂
C. 含抑汗剂的爽身粉
D. 防蛀漱口水
E. 脱毛霜

正确答案：A。含抑制螨虫剂的洗头水

解析：本题考查化妆品。化妆品是指以涂擦、喷洒或其他类似方法，散布于人体表面（皮肤、毛发、指甲、口唇等）、牙齿以及口腔黏膜，以清洁、保护、美化、修饰以及保持其处于良好状态为目的的产品。香皂（B对）、含抑汗剂的爽身粉（C对）、防蛀漱口水（D对）和脱毛霜（E对）均符合化妆品的定义。含抑制螨虫剂的洗头水（A错，为本题正确答案）不符合化妆品的定义。